下列哪种物质不是抗体
A. 新生儿从母体得到的IgG
B. 胎盘球蛋白
C. IgA
D. 抗毒素血清
E. 免疫佐剂

正确答案：E。免疫佐剂